其左旋体有镇咳作用的药物是
A. 盐酸纳洛酮
B. 酒石酸布托啡诺
C. 右丙氧芬
D. 苯噻啶
E. 磷酸可待因

正确答案：C。右丙氧芬